颌骨炎症性囊肿的病理过程不包括以下哪项
A. 牙齿龋坏
B. 牙髓炎症和坏死
C. 根尖周组织的炎症和（或）免疫反应
D. 牙槽骨坏死，吸收
E. Malassez上皮剩余增殖

正确答案：D。牙槽骨坏死，吸收

解析：颌骨炎症性囊肿的发生一般经历牙齿龋坏、牙髓炎症和坏死、根尖周组织的炎症和（或）免疫反应、马拉瑟（Malassez）上皮剩余增殖以及增殖上皮团块中央液化、囊性变等一系列可预测的病理过程。掌握“牙源性囊肿”知识点。